某男，25岁。不寐多梦，急躁易怒，头晕头胀，目赤耳鸣，口干面苦，不思饮食，便秘溲赤；舌红苔黄，脉弦数。诊断为不寐，证属肝火扰心，宜选用的基础方剂是
A. 柴胡疏肝散
B. 甘麦大枣汤
C. 龙胆泻肝汤
D. 半夏厚朴汤
E. 黄连温胆汤

正确答案：C。龙胆泻肝汤

解析：本题考查不寐之肝火扰心证的方剂应用。诊断为不寐，证属肝火扰心，宜选用的基础方剂是龙胆泻肝汤（C对）。不寐之肝火扰心证【症状】不寐多梦，甚则彻夜不眠，急躁易怒，伴头晕头胀，目赤耳鸣，口干而苦，不思饮食，便秘溲赤。舌红苔黄，脉弦而数。【治法】疏肝泻火，镇心安神。【方剂应用】基础方剂龙胆泻肝汤（龙胆、泽泻、木通、车前子、当归、柴胡、生地黄、黄芩、栀子、生甘草）加减。胃痛之肝气犯胃证【症状】胃脘胀痛，痛连两胁，遇烦恼则痛作或痛甚，嗳气、矢气则舒，脘闷嗳气，善太息，大便不畅。舌淡红，苔薄白，脉弦。【治法】疏肝解郁，理气止痛。【方剂应用】1.基础方剂柴胡疏肝散（A错）（柴胡、香附、枳壳、芍药、陈皮、川芎、炙甘草）加减。郁证之心神失养证【症状】精神恍惚，心神不宁，多疑易惊，悲忧善哭，喜怒无常，或时时欠伸，或手舞足蹈，骂詈喊叫等。舌质淡，脉弦。【治法】甘润缓急，养心安神。【方剂应用】基础方剂甘麦大枣汤（B错）（甘草、小麦、大枣）加减。郁证之痰气郁结证【症状】精神抑郁，胸部闷塞，胁肋胀满，咽中如有物梗塞，咽之不下，咯之不出。舌苔白腻，脉弦滑。【治法】行气开郁，化痰散结。【方剂应用】基础方剂半夏厚朴汤（D错）（半夏、厚朴、茯苓、生姜、苏叶）加减。不寐之痰热扰心证【症状】心烦不寐，胸闷脘痞，泛恶嗳气，伴口苦，头重，目眩。舌质偏红，苔黄腻，脉滑数。【治法】清化热痰，和中安神。【方剂应用】基础方剂黄连温胆汤（E错）（半夏、茯苓、陈皮、甘草、枳实、竹茹、黄连、大枣）加减。